耳、肾毒性最大的氨基糖苷类抗生素是
A. 卡那霉素
B. 庆大霉素
C. 西索米星
D. 奈替米星
E. 新霉素

正确答案：E。新霉素

解析：氨基糖苷类的肾毒性取决于各药在肾皮质中的聚积量和对肾小管的损伤能力，其发生率依次为新霉素＞卡那霉素＞庆大霉素＞妥布霉素＞阿米卡星＞奈替米星＞链霉素。掌握“氨基糖苷类抗生素”知识点。